因果关联是指
A. 暴露-疾病有较强的统计学关联
B. 暴露-疾病分类资料存在相关
C. 暴露-疾病排除偏倚后的关联
D. 暴露-疾病有时间先后的无偏关联

正确答案：D。暴露-疾病有时间先后的无偏关联

解析：本题考查因果关联。因果关联是指暴露-疾病有时间先后的无偏关联（D对ABC错）。